康复措施属于
A. 第一级预防
B. 第二级预防
C. 第三级预防
D. 第四级预防
E. 综合预防

正确答案：C。第三级预防

解析：第三级预防：对已患某些病者，采取及时的、有效的治疗和康复措施，使患者尽量恢复生活和劳动能力，能参加社会活动并延长寿命。掌握“预防医学概论、健康及三级预防策略”知识点。